舌杆上缘厚1mm，下缘厚为
A. 1mm
B. 2mm
C. 3mm
D. 4mm
E. 6mm

正确答案：B。2mm

解析：本题考查舌杆。舌杆上缘厚1mm，下缘厚为2mm（B对）。舌杆：位于下颌舌侧龈缘与舌系带或口底黏膜皱襞之间。舌杆纵剖面呈半梨形，边缘圆滑，上缘薄（1mm）而下缘厚（2mm），上缘离开牙龈缘至少3―4mm。